患者，女性，20岁。诉咀嚼无力两年余。口腔检查：下颌第一恒磨牙近远中牙周袋约8mm深，牙齿松动Ⅱ度。口腔卫生尚佳，下前牙牙石（+），松动Ⅱ度，拟诊
A. 侵袭性牙周炎
B. 慢性龈缘炎
C. 慢性牙周炎
D. 复合性牙周炎
E. 以上均不对

正确答案：A。侵袭性牙周炎

解析：局限型侵袭性牙周炎临床特点有以下方面：年龄与性别：①发病可始于青春期前后，患者就诊时常已20岁左右。女性多于男性；②口腔卫生情况：牙周组织破坏程度与局部刺激物的量不成比例。患者的菌斑、牙石量很少，牙龈表面的炎症轻微，但却已有深牙周袋；③好发牙位：局限型侵袭性牙周炎的特征是“局限于第一恒磨牙或切牙的邻面有附着丧失，至少波及两个恒牙，其中一个为第一磨牙。其他患牙（非第一磨牙和切牙）不超过两个”。简言之，典型的患牙局限于第一恒磨牙和上下切牙，多为左右对称。但早期的患者不一定波及所有的切牙和第一磨牙；④病程进展快：本型患者的牙周破坏速度比慢性牙周炎快3～4倍，在4～5年内，牙周附着破坏可达50%～70%，患者常在20岁左右即已须拔牙或牙自行脱落；⑥早期出现牙齿松动和移位：在炎症不明显的情况下。切牙和第一恒磨牙可出现松动，自觉咀嚼无力。切牙可向唇侧远中移位，出现牙间隙，多见于上切牙，由于力的影响导致呈扇形散开排列。后牙移位较少见，可出现不同程度的食物嵌塞。掌握“侵袭性牙周炎”知识点。